在一定条件下用强氧化剂如高锰酸钾、重铬酸钾等氧化水中有机物和无机物所消耗的氧量称为
A. 溶解氧含量
B. 化学耗氧量
C. 生化需氧量
D. 水体复氧量
E. 水中微生物产气量

正确答案：B。化学耗氧量

解析：本题考查化学耗氧量。化学耗氧量（B对ACDE错）指在一定条件下，用强氧化剂如高锰酸钾、重铬酸钾等氧化水中有机物所消耗的氧量。